肺结核患者治疗应强调
A. 增加营养
B. 卧床休息
C. 预防咯血
D. 合理化疗
E. 定期检查肝功能

正确答案：D。合理化疗